下列方剂组成药物中，不含有栀子的是
A. 茵陈蒿汤
B. 八正散
C. 凉膈散
D. 龙胆泻肝汤
E. 仙方活命饮

正确答案：E。仙方活命饮

解析：本题考查仙方活命饮的药物组成。仙方活命饮为清热剂，具有清热解毒，消肿散结，活血止痛之功效。由白芷、贝母、防风、赤芍药、当归尾、甘草节、皂角刺(炒)、穿山甲(炙)、天花粉、乳香、没药、金银花、陈皮组成（E对）。茵陈蒿汤由茵陈、栀子、大黄（A错）。八正散由车前子、瞿麦、萹蓄、滑石、山栀子仁、甘草、木通、大黄组成（B错）。凉膈散由川大黄、朴硝、甘草、山栀子仁、薄荷、黄芩、连翘组成（C错）。龙胆泻肝汤由龙胆草、黄芩、栀子、泽泻、木通、当归、生地黄、柴胡、生甘草、车前子组成（D错）。